初产妇，25岁，妊娠38周，宫口开全，宫缩40次/分，胎心100次/分，羊水III度，正常骨盆，头先露，S＝+3，首选的治疗措施
A. 继续观察自然分娩
B. 静脉滴注缩宫素
C. 产钳助产
D. 应用镇静剂
E. 剖宫产

正确答案：C。产钳助产

解析：患者初产妇，25岁，妊娠38周，宫口开全，宫缩40次/分，胎心100次/分，羊水III度，正常骨盆，头先露，S＝+3（提示胎头已下降至坐骨棘平面以下3cm），结合患者的表现，首选产钳助产（C对）。